患儿7岁，主诉左下后牙有龋洞，冷热疼痛，无自发疼。查：6深龋洞，叩诊（-），牙龈正常。X-ray示牙根未形成，未见病变。处理：去除大部分腐质，近中髓角去腐时穿髓1mm穿髓孔探疼，应选何种治疗方法
A. 活髓切断术
B. 直接盖髓术
C. 拔髓术
D. 根尖诱导成形术
E. 封金属砷后根管治疗

正确答案：A。活髓切断术

解析：患儿7岁，主诉左下后牙有龋洞，冷热疼痛，无自发疼。查：6深龋洞，叩诊（-），牙龈正常。X-ray示牙根未形成，未见病变。处理：去除大部分腐质，近中髓角去腐时穿髓1mm穿髓孔探疼，应选活髓切断术（A对）。根尖未发育完成的年轻恒牙，无论是龋源性、外伤性或机械性露髓，均可行牙髓切断术以保存活髓，直到牙根发育完成。当根尖孔尚未发育完全，因机械性或外伤性露髓的年轻恒牙或根尖孔发育完全，机械性或外伤性露髓，穿髓孔直径不超过0.5mm的恒牙可适用于直接盖髓术，因患者根尖未发育完全，且为龋源性露髓，穿髓孔为1mm，不能用于直接盖髓术（B错）。患牙冷热刺激痛，有探痛，但无自发痛，所以不是不可复性牙髓炎，也不可能为根尖周炎，无需拔髓和根管治疗，且年轻恒牙根尖孔未闭合，不能根管治疗（CE错）。根尖诱导成形术是指牙根未完全形成之前严重牙髓和根尖周炎症的年轻恒牙，患者并无严重的牙髓炎和根尖周炎（D错）。